肾性贫血宜选用的药物是
A. 人促红素
B. 碳酸镧
C. 非诺贝特
D. 氢氧化铝
E. 骨化三醇

正确答案：A。人促红素

解析：本题考查肾性贫血治疗药物。肾性贫血可选用重组人红细胞生成素。人促红素（A对）有促进红细胞生成作用，是治疗这类贫血有效的药物。